68岁男性，咳嗽咳痰3个月，胸痛1周，CT示：肺尖3×2cm肿块。假设患者未治疗，8个月后，出现呼吸困难，侧卧不能缓解，右侧胸部大量胸腔积液，CT示右侧肺尖部4×3cm肿块，胸椎、肋骨多发转移，问为缓解症状当前最佳治疗措施是
A. 全身化疗
B. 同步放化疗
C. 胸椎放疗
D. 局部放疗
E. 胸腔闭式引流

正确答案：E。胸腔闭式引流

解析：根据题干诊断考虑肺癌并广泛转移，出现呼吸困难并改变体位不能缓解，考虑右侧大量胸腔积液压迫导致，缓解症状最佳措施为胸腔闭式引流（E对），迅速解除压迫症状，缓解患者呼吸困难。全身化疗、同步放化疗、胸椎放疗、局部放疗是肺癌晚期患者一般治疗措施，尚不能快速解决呼吸困难（ABCD错）。